T产生的能活化T、B、MΦ的是
A. IL-1
B. IL-2
C. IL-8
D. IL-5
E. IL-6

正确答案：B。IL-2